初治活动性肺结核的每日用药方案是
A. 2HRZE/4HR
B. 2H3R3Z3E3/4H3R3
C. 2HRZSE/6-10HRE
D. 2HgR3Z3S3E3/6-10HgRgE3
E. 2HRZES/4HRE

正确答案：A。2HRZE/4HR

解析：初治活动性肺结核（含涂阳和涂阴）治疗方案：（1）每日用药方案：①强化期：异烟肼、利福平、吡嗪酰胺和乙胺丁醇，顿服，2个月。②巩固期：异烟肼、利福平，顿服，4个月。简写为：2HRZE/4HR（A对）。（2）间歇用药方案：①强化期：异烟肼、利福平、吡嗪酰胺和乙胺丁醇，隔日一次或每周3次，2个月。②巩固期：异烟肼、利福平，隔日次或每周3次，4个月。简写为：2H3R3Z3E3/4H3R3（B错）。